下列哪项不是高血压病的并发症
A. 短暂性脑缺血发作
B. 脑血栓形成
C. 脑出血
D. 脑栓塞
E. 高血压脑病

正确答案：D。脑栓塞

解析：长期高血压，由于小动脉微动脉瘤形成及脑动脉粥样硬化，所以短暂性脑缺血发作（A对）、脑血栓形成（B对）、脑出血（C对）、高血压脑病（E对）均是高血压病的并发症。而脑栓塞是指因异常的固态、液态、气态物体（被称作栓子）沿血循环进人脑动脉系统，引起动脉管腔闭塞，导致该动脉供血区局部脑组织的坏死，故不是高血压的并发症（D错，为本题正确答案）。